药物与辅料构成的直径小于2.5mm的球状实体称为
A. 微囊
B. 滴丸
C. 栓剂
D. 微丸
E. 软胶囊

正确答案：D。微丸